IgM是
A. 分子结构上的铰链区
B. 天然的血型抗体
C. 溶血作用比IgG强
D. 在个体发育中合成较晚
E. 由4个单体链连城的四聚体

正确答案：B。天然的血型抗体

解析：本题考查IgM。IgM是天然的血型抗体（B对），也是初次体液免疫应答中最早出现的抗体（D错）。分泌型IgM为五聚体（E错），是分子量最大的Ig，沉降系数为19S，称为巨球蛋白，一般不能通过血管壁，主要存在于血液中。